子宫颈早期浸润癌浸润深度的标准是
A. 不超过基底膜下1mm
B. 不超过基底膜下5mm
C. 不超过基底膜下2mm
D. 不超过基底膜下3mm
E. 不超过基底膜下4mm

正确答案：B。不超过基底膜下5mm

解析：子宫颈早期浸润癌指癌细胞突破基底膜，向固有膜间质内浸润，浸润深度的标准是不超过基底膜下5mm（B对）。